低钾血症时横纹肌溶解的机制是
A. 细胞释钾减少
B. 血管扩张减少
C. 肌痉挛
D. 缺血缺氧
E. 以上都是

正确答案：E。以上都是

解析：低钾血症时细胞外液钾浓度降低，细胞释钾减少（A对），醛固酮分泌减少，血管收缩（B对），骨骼肌血流量减少，以致发生缺血缺氧性肌痉挛（CD对，故E为本题正确答案），横纹肌溶解。